具有较强镇吐作用的是
A. 氯丙嗪
B. 氟西汀
C. 碳酸锂
D. 吗啡
E. 卡马西平

正确答案：A。氯丙嗪

解析：本题考查药品的作用。具有较强镇吐作用的是氯丙嗪（A对）。1.氯丙嗪对中枢神经系统的作用：（1）抗精神分裂症作用：氯丙嗪对中枢神经系统有较强的抑制作用，也称神经安定作用；（2）镇吐作用：氯丙嗪具有较强的镇吐作用；（3）对体温调节的作用：氯丙嗪对下丘脑体温调节中枢有很强的抑制作用，与解热镇痛药不同，氯丙嗪不仅降低发热机体的体温，也能降低正常体温。2.氟西汀（B错）：（1）治疗抑郁症；（2）治疗神经性贪食症。3.碳酸锂（C错）用于治疗躁狂症，躁狂症的特征是情绪高涨、烦躁不安、活动过度和思维、言语不能自制。4.吗啡（D错）是麻醉性镇痛药的典型代表，镇痛作用非常强。5.卡马西平（E错）：具有抗癫痫、镇痛、抗心律失常作用，另可刺激抗利尿激素释放，加强远端肾小管水分全吸收，具有抗利尿作用。是目前治疗原发性三叉神经痛的首选药物。